治疗黏液性水肿的药物是
A. 甲基硫氧嘧啶
B. 甲巯咪唑
C. 碘制剂
D. 甲状腺素
E. 卡比马唑（甲亢平）

正确答案：D。甲状腺素